下列抽样方法中需要按混杂因素（非研究因素）将总体分为若干组的方法是
A. 单纯随机抽样
B. 系统抽样
C. 随意抽样
D. 分层抽样
E. 机械抽样

正确答案：D。分层抽样